根呈圆柱形，略扭曲，长10～20cm，直径0.2～0.5cm，上部多有显著的横皱纹，下部较细，有纵皱纹及支根痕，味甚苦的药材是
A. 泽泻
B. 板蓝根
C. 龙胆
D. 南沙参
E. 防风

正确答案：C。龙胆

解析：本题考查的是龙胆药材的鉴别。根呈圆柱形，略扭曲，长10～20cm，直径0.2～0.5cm，上部多有显著的横皱纹，下部较细，有纵皱纹及支根痕，味甚苦的药材是龙胆（C对）。龙胆：【性状鉴别】药材根茎呈不规则块状；表面暗灰棕色或深棕色，上端有茎痕或残留茎基，周围和下端着生多数细长的根。根圆柱形，略扭曲；表面淡黄色或黄棕色，上部多有显著的横皱纹，下部较细，有纵皱纹及支根痕。质脆，易折断，断面略平坦，皮部黄白色或淡黄棕色，木部色较浅，呈点状环列。气微，味甚苦。泽泻（A错）：【性状鉴别】药材呈类球形、椭圆形或卵圆形。表面淡黄色至淡黄棕色，有不规则的横向环状浅沟纹和多数细小突起的须根痕，底部有的有瘤状芽痕。质坚实，断面黄白色，粉性，有多数细孔。气微，味微苦。板蓝根（B错）：【性状鉴别】药材呈圆柱形，稍扭曲。表面淡灰黄色或淡棕黄色，有纵皱纹、横长皮孔样突起及支根痕。根头略膨大，可见暗绿色或暗棕色轮状排列的叶柄残基和密集的疣状突起。体实，质略软，断面皮部黄白色，木部黄色。气微，味微甜后苦涩。南沙参（D错）：【性状鉴别】药材呈圆锥形或圆柱形，略弯曲。表面黄白色或淡棕黄色，凹陷处常有残留粗皮，上部多有深陷横纹，呈断续的环纹，下部有纵纹及纵沟。顶端具1或2个根茎。体轻，质松泡，易折断，断面不平坦，黄白色，多裂隙。气微，味微甘。防风（E错）：【性状鉴别】药材呈长圆锥形或长圆柱形，下部渐细，有的略弯曲。根头部有明显密集的环纹，习称“蚯蚓头”，环纹上有的有棕褐色毛状残存叶基。表面灰棕色或棕褐色，粗糙，有纵皱纹、多数横长皮孔及点状突起的细根痕。体轻、质松，易折断，断面不平坦，皮部棕黄色至棕色，有裂隙，散生黄棕色油点，木质部浅黄色。气特异，味微甘。